（牙合）面形态为“田”字形的是
A. 下颌第一磨牙
B. 上颌第一磨牙
C. 下颌第二磨牙
D. 上颌第二磨牙
E. 第三磨牙

正确答案：C。下颌第二磨牙

解析：本题考查上下颌磨牙的外形及临床应用解剖。下颌第二磨牙（C对）（牙合）面发育沟为“十”字形，（牙合）面形态为“田”字形。